食品安全工作实行的原则不包括
A. 预防为主
B. 风险管理
C. 量化评价
D. 全程控制
E. 社会共治

正确答案：C。量化评价